小兰被妈妈带着到牙防所做窝沟封闭，经检查后大夫告诉她小兰的六龄齿可以暂不做窝沟封闭，注意养成良好的口腔卫生习惯。因为小兰
A. 六龄齿均已患龋
B. 牙列正畸后再做
C. 窝沟不深自洁好
D. 全口牙列无龋坏
E. 充填龋齿后再做

正确答案：C。窝沟不深自洁好

解析：窝沟封闭的非适应证：牙面无深的沟裂点隙、自洁作用好不适合封闭。患者不能配合正常操作以及牙尚未完全萌出，被牙龈覆盖则不适合封闭。掌握“窝沟封闭术”知识点。